根据某高速公路交通事故统计，蓝色车子的车祸发生事件比其他车子的车祸发生事件要多。由此推论：蓝色车子发生车祸的危险性高于其他车子。此推论
A. 正确
B. 不正确，因为没有进行统计学显著性检验
C. 不正确，因为以流行率而未用发病率比较
D. 不正确，因为不是基于率的比较
E. 不正确，因为没有对照组

正确答案：D。不正确，因为不是基于率的比较